患者，女，35岁。面浮肢肿，身热汗出，口渴不欲饮，腹胀纳少，尿黄短少，舌红苔黄腻，脉滑数。治疗首选方
A. 防己黄芪汤合春泽汤
B. 济生肾气丸
C. 归芍地黄汤
D. 三仁汤
E. 胃苓汤

正确答案：D。三仁汤

解析：综合患者临床表现，可诊断患者为慢性肾小球肾炎湿热证型，治以清热利湿，以三仁汤为主方（D对）。济生肾气丸为慢性肾小球肾炎脾肾阳虚证型的代表主方（B错）。胃苓汤为慢性肾小球肾炎湿浊证的主方（E错）